具有“喜润恶燥”特性的脏腑是
A. 肝
B. 心
C. 脾
D. 胃
E. 大肠

正确答案：D。胃

解析：胃主受纳腐熟，不仅依赖胃气的推动，亦需胃中津液的濡润。胃中津液充足，则能维持其受纳腐熟机能和通降下行的特性。又胃为阳土，其病易成燥热之害，胃中津液每多受损，故胃有喜润而恶燥的生理特性，与脾喜燥恶湿相对而言（D对）。肝的生理特性有肝为刚脏，肝气升发（A错）；肺的生理特性为心主通明、心火宜降（B错）；脾的生理特性有喜燥恶湿，脾气上升（C错）。